未取得处方权或者被取消处方权后开具药品处方的
A. 给予警告
B. 吊销其印鉴卡
C. 吊销其执业证书
D. 追究刑事责任
E. 责令暂停6个月以上1年以下执业活动

正确答案：E。责令暂停6个月以上1年以下执业活动

解析：医师出现下列情形之一的，按照《执业医师法》第37条的规定，由县级以上卫生行政部门给予警告或者责令暂停6个月以上1年以下执业活动；情节严重的，吊销其执业证书：①未取得处方权或者被取消处方权后开具药品处方的；②未按照《处方管理办法》规定开具药品处方的；③违反《处方管理办法》其他规定的。掌握“处方的开具、监督管理及法律责任”知识点。